病原菌与其传播途径组合错误的是
A. 淋病奈瑟菌——性传播
B. 伤寒沙门菌——消化道传播
C. 引起猩红热的A群链球菌——血行传播
D. 脑膜炎奈瑟菌——呼吸道传播
E. 肺炎链球菌——呼吸道传播

正确答案：C。引起猩红热的A群链球菌——血行传播